女，24岁。停经6周诊断为早孕，行人工流产术，吸宫后探宫腔发现探不到宮底，出血不多，自述心悸、轻度腹痛及恶心。该患者最可能的诊断是
A. 子宫畸形
B. 子宫穿孔
C. 人工流产综合反应
D. 羊水栓塞
E. 葡萄胎

正确答案：B。子宫穿孔

解析：该患者停经6周诊断为早孕，行人工流产术，吸宫后探宫腔发现探不到宮底（手术时突然感到无宫底感觉，或手术器械进入深度超过原来所测得深度，提示子宫穿孔），出血不多，自述心悸轻度腹痛及恶心，最可能的诊断是子宫穿孔（B对）。子宫畸形（P280）（A错）可表现为双子宫、双角子宫、残角子宫等，主要经B超确诊。人工流产综合反应（P384）（C错）表现为患者在术中或术毕出现恶心呕吐、心动过缓、心律不齐、面色苍白、头昏、胸闷、大汗淋漓，严重者出现血压下降、昏厥、抽搐等症状。羊水栓塞（P216）（D错）少见，往往由于宫颈损伤、胎盘剥离使血窦开放，为羊水进入创造条件，即使并发羊水栓塞，其症状及严重性不如晚期妊娠发病凶猛。葡萄胎（P336）（E错）主要表现为停经后阴道流血、子宫异常增大、变软。